下列消毒目的错误的是
A. 防止并发症
B. 防止交叉感染
C. 防止传染病学传播
D. 保护医护人员免受感染
E. 避免患者重复感染

正确答案：E。避免患者重复感染

解析：消毒的目的：防止病原体播散到社会中引起传染病的流行（C对）；防止患者发生交叉感染（B对），出现并发症（A对）；保护医护人员免受感染（D对）。有效地控制感染除消毒外，还须同时进行必要的隔离措施和工作中的合理防护和无菌操作（E错，为本题正确答案）。